重型溃疡性结肠炎首选药物
A. 肾上腺糖皮质激素
B. 水杨酸柳氮磺胺嘧啶
C. 免疫抑制剂
D. 抗生素
E. 乳酸杆菌制剂

正确答案：A。肾上腺糖皮质激素

解析：溃疡性结肠炎可分为轻度中度和重度。轻度：腹泻＜4次/日，便血轻或无，无发热，贫血无或轻，血沉正常。重度：腹泻＞6次/日，有明显黏液脓血便，体温＞37.5℃、脉搏＞90次/分，血红蛋白＜100g/L，血沉＞30mm/h。中度介于轻度与重度之间（P374）。轻中度溃疡性结肠炎治疗首选5-氨基水杨酸（B错），重度溃疡性结肠炎首选糖皮质激素（A对），对激素治疗效果不佳或对激素依赖的慢性持续型病例可选用免疫抑制剂（C错）。重症溃疡性结肠炎继发感染者，应积极抗菌治疗（D错）。乳酸杆菌制剂（E错）可调节肠道菌群，与5-氨基水杨酸联用对溃疡性结肠炎有良好效果。